支原体与L型细菌的最主要区别是
A. 缺乏细胞壁
B. 具有DNA和RNA两种核酸
C. 可通过细菌滤器
D. 培养时形成油煎蛋样菌落
E. 形态结构不因有无青霉素等诱因而改变

正确答案：E。形态结构不因有无青霉素等诱因而改变

解析：支原体有许多特性与L型细菌相似，如无细胞壁呈多形性、能通过滤菌器、对低渗敏感、“油煎蛋”样菌落，但L型细菌在无抗生素等诱导因素下易返祖为原菌，支原体则在遗传上与细菌无关。掌握“支原体”知识点。